下列有关牙周膜的功能，除外
A. 支持功能
B. 感觉功能
C. 形成功能
D. 营养功能
E. 保护功能

正确答案：E。保护功能

解析：牙周膜的功能包括：①支持功能：牙周膜主纤维一端埋入牙骨质中，一端埋入牙槽骨，将牙固定在牙槽窝中；②感觉功能：牙周膜中有丰富的神经和末梢，对疼痛、压力和震动等感觉敏锐。③营养功能：牙周膜中丰富的血供不仅营养牙周膜本身，也营养牙骨质和牙槽骨。④形成功能：牙周膜不断地进行更新和改建。掌握“牙周膜”知识点。